湿热藴脾可见
A. 尿频尿急，尿道灼痛，尿黄短少
B. 头痛目赤，急躁易怒，胁痛便秘
C. 腹部痞闷，纳呆便溏，面目发黄
D. 腹痛下痢，赤白黏冻，里急后重
E. 阴囊湿疹，瘙痒难忍，小便短赤

正确答案：C。腹部痞闷，纳呆便溏，面目发黄

解析：湿热藴脾证证候表现为腹部痞闷，纳呆便溏，面目发黄，舌质红，苔黄腻，脉濡数。湿热蕴结脾胃，气机阻滞，升降失常，故腹部痞闷，纳呆；湿热下注大肠，肠道气机不畅，则便溏；湿热蕴结脾胃，熏蒸肝胆，肝失疏泄，胆汁不循常道而泛溢肌肤，故面目发黄（C对）。尿频尿急，尿道灼痛，尿黄短少（A错）可见于膀胱湿热证。头痛目赤，急躁易怒，胁痛便秘（B错）可见于肝火炽盛证。腹痛下痢，赤白黏冻，里急后重（D错）可见于大肠湿热证。阴囊湿疹，瘙痒难忍，小便短赤（E错）可见于肝胆湿热证。